均属于无菌制剂的是
A. 舌下片
B. 滴眼液
C. 漱口液
D. 滴耳液
E. 栓剂

正确答案：B。滴眼液

解析：本题考查药物制剂。均属于无菌制剂的是滴眼液（B对）。滴眼液属于眼用制剂，眼用制剂系指直接用于眼部发挥治疗作用的无菌制剂。舌下片（A错）、漱口液（C错）均没有无菌要求；滴耳液（D错）是滴耳剂中的一种，滴耳剂系要求为灭菌制剂；栓剂（E错）有微生物限度。